分子中含有香豆素的内酯结构，易与多种药物发生相互作用而影响安全性的抗凝药物是
A. 盐酸噻氯匹定
B. 华法林钠
C. 奥扎格雷
D. 硫酸氯匹格雷
E. 替罗非班

正确答案：B。华法林钠

解析：本题考查药物的相互作用。华法林钠（B对）的分子中含有香豆素的内酯结构，可与水合氯醛、保泰松及雷尼替丁等发生相互作用，增加抗凝作用，从而增加出血倾向。盐酸噻氯匹定（A错）及奥扎格雷（C错）均不含香豆素，且都具有抗血小板凝集作用；硫酸氯匹格雷（D错）含甲酯不含香豆素的内酯结构，具有抑制血小板聚集的作用；替罗非班（E错）含磺酰胺基，用于抗心绞痛。